体内主要脱氨基方式是
A. 氧化脱氨基
B. 还原脱氨基
C. 直接脱氨基
D. 转氨基
E. 联合脱氨基

正确答案：E。联合脱氨基

解析：氨基酸的转氨基作用和谷氨酸的氧化脱氨基作用偶联进行的方式称为联合脱氨基作用，联合脱氨基是体内主要脱氨基方式。掌握“氨基酸及氨的代谢”知识点。